学习负荷过量时会出现
A. 疲劳
B. 早期疲劳
C. 显著疲劳
D. 疲倦
E. 过劳

正确答案：C。显著疲劳